氨基糖苷类抗生素所致的耳聋，属于
A. 副作用
B. 毒性反应
C. 后遗效应
D. 继发反应
E. 首剂效应

正确答案：B。毒性反应

解析：本题考查药品的不良反应。氨基糖苷类抗生素所致的耳聋，属于毒性反应（B对）。毒性反应是指在药物剂量过大或体内蓄积过多时发生的危害机体的反应。短期内过量用药引起的毒性称急性毒性反应，多损害循环、呼吸及神经系统功能。副作用（A错）是指在药物按正常用法用量使用时，出现的与治疗目的无关的不适反应。后遗效应（C错）是指在停药后血药浓度已降低至最低有效浓度以下时仍残存的药理效应。继发反应（D错）是由于药物的治疗作用所引起的不良反应。首剂效应（E错）是指一些患者在初服某种药物时，由于机体对药物作用尚未适应而引起不可耐受的强烈反应。例如哌唑嗪等按照常规剂量开始治疗常可致血压骤降。